经血成不凝状态的原因是
A. 月经量多
B. 有宫颈黏液
C. 含有前列腺素
D. 含有大量纤溶酶
E. 含有脱落的阴道上皮细胞

正确答案：D。含有大量纤溶酶

解析：月经血的特征月经血一般呈暗红色，其成分除血液外，还有子宫内膜碎片、宫颈黏液（B错）及脱落的阴道上皮细胞（E错）。月经血中含有前列腺素（C错）及来自子宫内膜的大量纤溶酶，由于纤溶酶（D对）可溶解纤维蛋白，月经血不凝。出血多（A错）时可有血凝块。